下列有关后牙（牙合）运循环中生物力学杠杆作用的描述中，正确的是
A. 在后牙（牙合）运循环中非工作侧髁突向工作侧移动
B. 可构成第Ⅱ类杠杆
C. 工作侧咬肌、颞肌、翼内肌皆用较大力量参与
D. 翼外肌则起着平衡作用，以免关节受损
E. 以上都正确

正确答案：E。以上都正确

解析：后牙（牙合）运循环中生物力学杠杆作用：在后牙（牙合）运循环中非工作侧髁突虽向工作侧移动，但仍为翼外肌、颞肌、舌骨上下肌群所稳定，作为支点，工作侧的升颌肌群以咬肌与翼内肌收缩为力点，研磨食物处为重点，构成第Ⅱ类杠杆。在此运动中，工作侧咬肌、颞肌、翼内肌皆用较大力量参与，而翼外肌则起着平衡作用，制止髁突使其不致向后上猛力冲撞，以免关节受损。掌握“咀嚼过程、类型，咀嚼周期及生物力”知识点。